患者哮喘多年，气短息弱，自汗畏风，面色㿠白，咳嗽痰稀，舌淡苔白，脉弱。其诊断是
A. 哮证缓解期，肺虚
B. 哮证缓解期，脾虚
C. 哮证缓解期，肾虚
D. 虚喘，肺虚
E. 虚喘，肾虚

正确答案：A。哮证缓解期，肺虚

解析：本病例患者以“气短息弱”为主症，又有哮喘多年的病史，故诊断为哮病缓解期；肺虚不能主气，气不能化津，痰饮蕴肺，故气短息弱，咳痰清稀色白；卫气不固，不能充实腠理，外邪易袭，故自汗畏风，常易感冒，每因气候变化而诱发；面色㿠白，舌苔薄白，质淡，脉细弱或虚大，皆为肺气虚弱之征，故属于肺虚证（A对）。哮证缓解期之脾虚证，其证候为“平素痰多气短，倦怠无力，面色萎黄，食少便溏，或食油腻易于腹泻，每因饮食不当则易诱发哮病，舌质淡，苔薄腻或白滑，脉细弱”(B错)。哮证缓解期之肾虚证，其证候为“平素短气息促，动则尤甚，吸气不利，或喉中有轻度哮鸣，腰膝酸软，脑转耳鸣，劳累后易诱发哮病。或畏寒肢冷，面色苍白，舌淡苔白，质胖嫩，脉象沉细。或颧红，烦热，汗出粘手，舌红苔少，脉细数”（C错）。“喘证是以呼吸困难，甚则张口抬肩，鼻翼煽动，不能平卧为临床特征的病证。喘证的症状轻重不一，轻者仅表现为呼吸困难，不能平卧；重者稍动则喘息不已，甚则张口抬肩，鼻翼煽动；严重者，喘促持续不解，烦躁不安，面青唇紫，肢冷，汗出如珠，脉浮大无根，甚则发为喘脱”，本病例无“喘促，动则喘甚”等临床症状（DE错）。